关于季节对儿童的生长发育的影响，以下说法错误的是
A. 婴儿出生后1～2年内体重的增长无明显的季节差异
B. 体重增加的季节性差异尤其显著，9～11月增加较快
C. 身高增加的季节性差异不同于体重
D. 7～9月，身高增加最快
E. 以半年为观察单位，体重增加的2/3发生在9月至次年2月

正确答案：D。7～9月，身高增加最快